Killip分级，心功能Ⅲ级指
A. 未闻及肺部啰音和第三心音
B. 肺部有啰音，但啰音的范围小于1/2肺野
C. 肺部有啰音，且啰音的范围大于1/2肺野（肺水肿）
D. 肺部可闻及散在的哮鸣音
E. 血压＜70/40mmHg

正确答案：C。肺部有啰音，且啰音的范围大于1/2肺野（肺水肿）

解析：根据有无心力衰竭表现及其相应的血流动力学改变严重程度，急性心肌梗死（AMI）引起的心力衰竭按Killip分级法可分为四级。肺部有啰音，且啰音的范围大于1/2肺野（肺水肿）（C对）符合心功能Ⅲ级。肺部有啰音，但啰音的范围小于1/2肺野（B错）符合心功能Ⅱ级。未闻及肺部啰音和第三心音（A错）符合心功能Ⅰ级。血压＜70/40mmHg（E错）（明显休克血压）符合心功能Ⅳ级时的心源性休克。肺部可闻及散在的哮鸣音（D错）常见于支气管哮喘患者。